溶血性贫血多见于（）中毒
A. 氯霉素
B. 砷化氢
C. 抗癌药
D. 苯中毒
E. 阿司匹林

正确答案：B。砷化氢